苦参原植物所属的科是
A. 苋科
B. 豆科
C. 伞形科
D. 兰科
E. 百合科

正确答案：B。豆科

解析：本题考查的是苦参的来源。苦参原植物所属的科是豆科（B对）。苦参：【来源】为豆科植物苦参的干燥根。原植物来源于苋科（A错）中药有牛膝、川牛膝等。原植物来源于伞形科（C错）的中药有当归、川芎、柴胡、白芷、羌活等。原植物来源于兰科（D错）的中药有天麻、白及、石斛、铁皮石斛等。原植物来源于百合科（E错）的中药有黄精、知母、川贝母、浙贝母、玉竹、重楼、土茯苓、天冬、麦冬、山麦冬等。